易通过血脑屏障进入中枢神经系统的物质是
A. 汞蒸汽
B. 汞离子
C. 氯化汞
D. 甲基汞
E. 升汞

正确答案：D。甲基汞

解析：本题考查易通过血脑屏障进入中枢神经系统的物质。甲基汞（D对ABCE错）易通过血脑屏障进入脑细胞，还能透过胎盘，进入胎儿脑中。脑细胞富含类脂质，而脂溶性的甲基汞对类脂质具有很高的亲和力，所以很容易蓄积在脑细胞内。